乳牙根尖周病的主要病因是
A. 乳牙外伤
B. 重度磨耗
C. 髓腔感染
D. 化学烧伤
E. 先天畸形

正确答案：C。髓腔感染

解析：本题考查乳牙根尖周病的病因。乳牙根尖周病的主要病因是髓腔感染（C对）。乳牙根尖周病最主要的病因是牙髓来源的感染，即髓腔感染，牙髓炎症导致牙髓坏死以后，细菌及其毒素、组织分解产物可通过根尖孔或根管侧支到达根尖周组织引起根尖周病。乳牙外伤（A错）、化学烧伤（D错）、先天畸形（E错）都也可引起乳牙根尖周病，但不常见。重度磨耗（B错）可能会引起恒牙牙髓炎症继发根尖周病，但不是乳牙会出现的问题。